常用的短期体内诱癌试验不包括
A. 小鼠睾丸染色体畸变试验
B. 小鼠皮肤肿瘤诱发试验
C. SD雌性大鼠乳腺癌诱发试验
D. 小鼠肺肿瘤诱发试验
E. 大鼠肝转变灶诱发试验

正确答案：A。小鼠睾丸染色体畸变试验